谷胚中赖氨酸含量较高，是因为其蛋白质主要是
A. 清蛋白＋谷蛋白
B. 球蛋白＋清蛋白
C. 谷蛋白＋球蛋白
D. 醇溶蛋白＋谷蛋白
E. 以上都不是

正确答案：B。球蛋白＋清蛋白